津液输布的主要通道是
A. 三焦
B. 分肉
C. 血府
D. 经络
E. 腠理

正确答案：A。三焦

解析：《素问·灵兰秘典论》说：“三焦者，决渎之官，水道出焉。”三焦是全身津液上下输布运行的通道。全身津液的输布和排泄，是在肺、脾、肾等脏腑的协同作用下完成的，但必须以三焦为通道（A对）。肉，指肌肉，《内经》称为“分肉”。全身肌肉赖脾胃运化的水谷精微的营养滋润，才能壮实丰满，并发挥其运动功能（B错）。脉是血液运行的管道（C错），故称为“血府”。经络，是经脉和络脉的总称，为人体运行气血（D错）、联络脏腑、沟通内外、贯穿上下的径路。腠理具有抵御外邪、排除汗液的作用（E错）。